新生儿甲状腺功能减低症下列哪项是错误的
A. 精神及动作反应迟钝
B. 食量少，吞咽缓慢，常腹泻
C. 很少哭吵、声音嘶哑
D. 生理性黄疸时间延长
E. 不爱活动，多睡

正确答案：B。食量少，吞咽缓慢，常腹泻

解析：新生儿甲状腺功能减低症错误的是食量少，吞咽缓慢，常腹泻（B错，为本题正确答案），相反该患儿常腹胀、便秘。除此以外该病还有精神及动作反应迟钝（A对）、很少哭吵，声音嘶哑（C对）、生理性黄疸时间延长（D对）、不爱活动，多睡（E对）等症状。